输卵管最狭窄的一段是
A. 漏斗部
B. 壶腹部
C. 峡部
D. 子宫部
E. 输卵管伞

正确答案：D。子宫部

解析：输卵管伞（D对）是输卵管最狭窄的一段。